注射破伤风类毒素
A. 人工自动免疫
B. 人工被动免疫
C. 两者都是
D. 两者都不是

正确答案：A。人工自动免疫

解析：本题考查人工自动免疫。人工自动免疫指采用人工免疫的方法将疫（菌）苗和类毒素等抗原接种到人体，使机体自身的免疫系统产生对相关传染病的特异性免疫力。注射破伤风类毒素是人工自动免疫（A对BCD错）。